下列不是按照种植体植入部分进行分类的一项是
A. 牙内骨内种植体
B. 黏膜内种植体
C. 穿下颌种植体
D. 两段式种植体
E. 骨内种植体

正确答案：D。两段式种植体

解析：目前种植体还没有一个统一的分类标准，但通常人们按植入部位及种植体形状进行分类。按植入部位区分的有：骨内种植体、骨膜下种植体、牙内骨内种植体、黏膜内种植体以及穿下颌种植体和下颌支支架种植体等；按手术方式又分为一段式和两段式种植体；按不同外形又可分为叶状、螺旋形、桶状、柱状及根形等类型。掌握“牙种植术概论”知识点。